鉴别中央型腰椎间盘突出症与椎管内肿瘤最有意义的检查是
A. MRI
B. 鞍区感觉检查
C. CT
D. X线
E. 肛门括约肌检查

正确答案：A。MRI

解析：中央型椎间盘突出症为椎间盘发生退行性病变后，髓核向后压迫脊髓，引起的一系列症状及体征，MRI以椎间盘髓核向后突出、脊髓受压为主要表现。椎管内肿瘤MRI表现为椎管内占位性病变累及或压迫脊髓、神经根、脊膜等。因此，鉴别中央型椎间盘突出症与椎管内肿瘤最有意义的检查是MRI（A对）。椎间盘突出症和椎管内肿瘤压迫马尾神经时，均可出现鞍区感觉障碍；压迫骶节以下脊髓时，可出现肛门括约肌松驰，故鞍区感觉实验（B错）、肛门括约肌检查（E错）不能将两者相鉴别。CT（C错）和X线（D错）可以较清晰地显示出椎管内肿瘤引起的脊柱骨质破坏，但对脊髓、椎间盘等软组织的显示效果不佳，对椎管内肿瘤和中央型椎间盘突出的鉴别诊断价值不及MRI。